最常见的职业性致癌因素是
A. 生产性毒物和各种物理因素
B. 化学性因素和生物性因素
C. 化学性致癌物和某些生产过程
D. 生物性致癌物和某些生产过程
E. 药物和某些生产过程

正确答案：C。化学性致癌物和某些生产过程

解析：本题考查最常见的职业性致癌因素。职业性致癌因素包括化学因素、物理因素和生物因素，其中最常见的职业性致癌因素是化学性致癌物和某些生产过程（C对ABDE错）。